下列哪种不属病毒结构对称型
A. 螺旋对称型
B. 有包膜20面体立体对称型
C. 无包膜20面体立体对称型
D. 复合对称型
E. 球形对称型

正确答案：E。球形对称型

解析：病毒衣壳根据其壳粒的排列不同，有三种对称排列类型，即20面体立体对称型、螺旋对称型及复合对称型。衣壳与核酸构成核衣壳，无包膜病毒类的核衣壳即为病毒粒子（病毒体）。掌握“病毒形态、结构、增殖及影响因素”知识点。